某男，65岁。胸痛胸闷，胸胁胀满，心悸，唇舌紫暗，脉涩。宜选用的方剂是
A. 血府逐瘀汤加减
B. 附子汤加减
C. 补阳还五汤加减
D. 当归四逆汤加减
E. 生脉散加减

正确答案：A。血府逐瘀汤加减

解析：本题考查的是胸痹的辨证论治。该证属于气滞血瘀，方剂应用：血府逐瘀汤加减（A对）。胸痹是指以胸部闷痛，甚则胸痛彻背，短气、喘息不得卧为主症的疾病，轻者仅感胸闷如窒，呼吸欠畅，重者则有胸痛，严重者心痛彻背，背痛彻心。（一）气虚血瘀证：【方剂应用】基础方剂为补阳还五汤（当归、川芎、黄芪、桃仁、红花、地龙、赤芍）加减（C错）。（二）气滞血瘀证：【方剂应用】基础方剂为血府逐瘀汤（当归、生地、桃仁、红花、枳壳、赤芍、柴胡、川芎、桔梗、牛膝、甘草）加减。（三）痰浊痹阻证：【方剂应用】基础方剂为瓜蒌薤白半夏汤（瓜蒌、薤白、半夏、白酒）合涤痰汤（制半夏、制南星、陈皮、枳实、茯苓、人参、石菖蒲、竹茹、甘草、生姜）加减。（四）寒凝心脉证：【方剂应用】基础方剂为枳实薤白桂枝汤（枳实、厚朴、薤白、桂枝、瓜蒌实）合当归四逆汤（当归、桂枝、芍药、细辛、通草、炙甘草、大枣）加减（D错）。（五）气阴两虚证：【方剂应用】基础方剂为生脉散（人参、麦冬、五味子）合人参养荣汤（人参、熟地黄、当归、白芍、白术、茯苓、黄芪、陈皮、五味子、桂心、远志、炙甘草）加减（E错）。方剂应用为附子汤加减（B错）的病证，2022年考试指南未明确说明。